女，38岁。进行性贫血、消瘦、乏力半年，有时右腹隐痛，无腹泻。查体：右中腹部扪及肿块，肠音活跃。行标准根治术后病理结果为DukesB期，其5年生存率为
A. 25%
B. 35%
C. 45%
D. 55%
E. 65%

正确答案：E。65%

解析：患者消瘦、乏力，贫血，右中腹肿块（右侧结肠癌的典型症状），诊断为结肠癌，行标准根治术后病理结果为Dukes B期，其5年生存率可达65%（E对）。